患者男，66岁。慢性咳喘20年，间断性下肢水肿5年。查体：血压120/80mmHg，颈静脉怒张，左下肺可闻及干、湿啰音，心界向左扩大，P2＞A2，三尖瓣区可闻及3/6级杂音。肝肋下3cm。该患者最可能的诊断是
A. 肥厚型心肌病
B. 风湿性心脏瓣膜病
C. 冠心病
D. 慢性肺源性心脏病
E. 肺纤维化

正确答案：D。慢性肺源性心脏病

解析：该患者有慢性阻塞性肺疾病的病史，已有肺动脉高压、右心功能不全的症状体征，考虑慢性肺源性心脏病的可能性较大。掌握“慢性肺源性心脏病”知识点。